更年期激素替代的适应证是
A. 子宫不规则出血
B. 更年期综合征伴肿瘤病史
C. 更年期综合征伴肝功能异常
D. 充血性心脏病
E. 骨质疏松症

正确答案：E。骨质疏松症

解析：本题考查更年期激素替代的适应证。目前普遍认为激素补充治疗是治疗卵巢功能衰退后发生更年期综合征及其他各种因雌激素降低而导致的退行性疾病效果最好作用最直接的治疗方法，其他药物都不能替代它的作用。同时雌激素替代治疗对骨质疏松症（E对ABCD错）不仅有治疗作用而且有预防作用。但该疗法对雌激素敏感疾病患者有增加风险的副作用，如血栓性疾病的发生风险增高。所以使用时要严格掌握适应证。